在规定溶剂中，药物从固体制剂中溶出的速度和程度，称为
A. 生物利用度
B. 绝对生物利用度
C. 相对生物利用度
D. 溶出度
E. 生物半衰期

正确答案：D。溶出度